内分泌腺的特征，错误的是
A. 无排泄管道，称无管腺
B. 血供丰富
C. 与神经系统无关
D. 体积较小
E. 分泌物直接进入血液循环

正确答案：C。与神经系统无关

解析：由于其旺盛的新陈代谢和激素的运送，内分泌腺的体积较小（D对），血液供应丰富（B对），无排泄管道，称无管腺（A对），分泌的物质称为激素，分泌物激素直接进入血液循环（E对）。内分泌腺与神经系统并不是割裂开来相互独立的两个系统，如在垂体中就分为腺垂体与神经垂体，垂体后叶的神经垂体的神经部就具有神经系统的结构，但其储存与释放抗利尿激素与催产素的功能又属于内分泌系统的范畴。再如机体的神经体液调节，像是甲状腺激素的分级调节，就受到了下丘脑和垂体的调控（C错，为本题正确答案）。